龋病的一级预防包括
A. 根管治疗、健康教育
B. 早期诊断、早期治疗
C. 窝沟封闭、氟防龋
D. 健康教育、充填治疗
E. 早期诊断、氟防龋

正确答案：C。窝沟封闭、氟防龋

解析：本题考查龋病的分级预防。龋病的一级预防包括窝沟封闭、氟防龋（C对）。龋病的一级预防包括：1.进行口腔健康教育，普及口腔健康知识，了解龋病发生的知识，树立自我保健意识，养成良好口腔卫生习惯。2.控制及消除危险因素，对口腔内存在的危险因素，应采取可行的防治措施，在口腔医师的指导下，合理使用氟化物及其他的防龋方法，如窝沟封闭、氟防龋等。早期诊断（E错）、早期治疗（B错），定期进行临床检查及X线辅助检查，发现早期龋及时进行充填治疗（D错）属于龋病的二级预防。对龋病引起的牙髓炎、根尖周炎进行根管治疗（A错）或其他恰当处理，防止炎症继续发展属于龋病的三级预防。